从某病在不同时间、地区发病率的变化中，找出哪些因素也在发生变化；揭示和核实发病率的变动与这些因素在人群中的暴露率的变动相一致，分析有无剂量﹣反应关系，从而可以形成病因假设
A. 求同法
B. 求异法
C. 共变法
D. 排除法
E. 类比法

正确答案：C。共变法